某卫生行政部门对其辖区内甲、乙两民营医院医疗技术人员的业务素质进行考核，在甲医院随机抽取100人，80人考核结果为合格，20人不合格；乙医院随机抽取150人，100人考核结果为合格，50人不合格。欲比较甲、乙两民营医院医疗技术人员的业务素质考核合格率，宜采用的统计分析方法是
A. 样本率与总体率比较的z检验
B. 两样本率比较的z检验
C. 两样本均数比较的t检验：
D. 两样本比较的秩和检验
E. 配对四格表资料的X²检验

正确答案：B。两样本率比较的z检验